香加皮的香气成分是
A. 杠柳皂苷K
B. 4-甲氧基水杨醛
C. 杠柳毒苷G
D. 苯甲酸
E. 牡丹酚

正确答案：B。4-甲氧基水杨醛

解析：本题考查的是香加皮的成分。香加皮的香气成分是4-甲氧基水杨醛（B对）。香加皮【成分】组成。含北五加苷A、B、C、D、E、F、G、H、I、J、K。其中苷G为杠柳毒苷（C错），为强心苷类。而杠柳皂苷K（A错）、H₁、E为C₂₁甾苷类，是孕甾烯醇酮的还原衍生物。香气成分为4-甲氧基水杨醛。